非洲地区，伤寒发病率维持在10/10万左右，今年伤寒患者在某城发生20例，该城市30万人，这种情况属于
A. 散发
B. 暴发
C. 隐性流行
D. 流行
E. 大流行

正确答案：A。散发